一般保存蔬菜、水果的适宜温度约是
A. 2℃
B. 4℃
C. 6℃
D. 10℃
E. 15℃

正确答案：D。10℃

解析：本题考查一般保存蔬菜、水果的适宜温度。一般保存蔬菜、水果的适宜温度是10℃左右（D对ABCE错），此温度既能抑制微生物生长繁殖，又能防止蔬菜、水果间隙结冰，避免在冰融时因水分溢出而造成蔬菜水果的腐败。